线片示右股骨下端溶骨性破坏，伴有骨膜反应，血碱性磷酸酶明显增高。最可能的诊断是
A. 转移性骨肿瘤
B. 骨肉瘤
C. 骨髓炎
D. 骨结核
E. 骨巨细胞瘤

正确答案：B。骨肉瘤

解析：患者青年女性，右大腿下端肿痛1个月。查体：局部软组织肿胀、压痛， X 线片示右股骨下端溶骨性破坏，伴有骨膜反应（骨肉瘤表现），血碱性磷酸酶明显增高。结合患者症状、体征及影像学检查，考虑诊断为骨肉瘤（B对）。转移性骨肿瘤（A错）多发于40～60岁的老人。儿童发生骨转移瘤主要来自肾上腺或交感神经节的成神经细胞瘤。好发于脊椎骨、骨盆和股骨。主要表现为疼痛、肿块、压迫症状和病理性骨折。骨髓炎（C错）以髋关节最多见，表现为骨质不规则增厚和硬化，有残留的骨吸收区或空洞，其中可有大小不等的死骨，有时看不到骨髓腔。骨结核（D错）X线表现为骨质破坏、关节间隙狭窄、周围软组织肿胀，除合并感染和修复外，骨质硬化少见。骨巨细胞瘤（E错）主要症状为疼痛和肿胀，局部有包块压之有乒乓球样感觉。典型X线特征为骨端偏心位、溶骨性、囊性破坏而无骨膜反应。